下列有关暂时冠的作用说法正确的是
A. 保护牙髓
B. 恢复功能
C. 保护牙周组织
D. 维持修复间隙
E. 以上说法均正确

正确答案：E。以上说法均正确

解析：本题考查暂时冠及印模与模型。暂时冠的作用：①保护牙髓（A对）；②保护牙周组织（C对）；③维持修复间隙（D对）；④恢复功能（B对）；⑤诊断作用。以上说法均对，选E。